首先明确区分外感发厥与内伤杂病厥证的医著是
A. 《卫生宝鉴》
B. 《景岳全书》
C. 《医贯》
D. 《医学入门》
E. 《医门法律》

正确答案：D。《医学入门》

解析：李梴《医学入门·外感寒暑》明确区分外感发厥与内伤杂病致厥（D对）。《景岳全书·厥逆》总结了明代以前对厥证的认识，提出以虚实论治厥证（B错）。